根据Lambert-Beer定律，吸收度与浓度和光路长度之间的正确关系式是
A. A=-lgT=-lg（I₀/I）=ECl
B. A=-lgT=-lg（I₀/I）=Cl
C. A=lgT=-lg（I/I₀）=Cl
D. A=lgT=-lg（I₀/I）=ECl
E. A=-lgT=-lg（I/I₀）=ECl

正确答案：E。A=-lgT=-lg（I/I₀）=ECl

解析：本题考查紫外-可见分光光度法。根据Lambert-Beer定律，吸收度与浓度和光路长度之间的正确关系式是A=-lgT=I/I₀=-lg（I/I₀）=ECl（E对）。根据Lambert-Beer定律，I/I₀是透光率，用T表示，又以A代表-lgT，称之为吸光度。